在成釉器钟状期时内釉上皮和星网状层之间出现2～3层细胞为
A. 外釉上皮层
B. 中间层
C. 成牙本质细胞层
D. 成牙骨质细胞层
E. 牙囊

正确答案：B。中间层

解析：本题考查成釉器的发育。在内釉上皮与星网状层之间有2～3层扁平细胞，细胞核卵圆或扁平状，称为中间层（B对）。在钟状期早期，细胞核居中，高尔基复合体、粗面内质网、线粒体和其它细胞器数量不多。到晚期，细胞间隙增大充满微绒毛，上述细胞器增多，酸性黏多糖及糖原沉积。中间层细胞具有高的碱性磷酸酶活性，与釉质的形成有关。外釉上皮层（A错）是成釉器周边的一单层立方状细胞，借牙板与口腔上皮相连。成牙本质细胞层（C错）中成牙本质细胞胞体位于牙髓周边紧接前期牙本质排列成一层，呈栅栏状。成牙骨质细胞层（D错）中成牙骨质细胞分布在临近牙骨质的牙周膜中，细胞平铺在根面上。牙囊（E错）起源于外胚间充质，形成于帽状期，帽状期时，包绕成釉器和牙乳头边缘的外胚间充质细胞密集成结缔组织层形成牙囊。